艾滋病健康教育的重点目标人群不包括
A. 艾滋病病毒感染者、艾滋病患者
B. 吸毒、同性恋者
C. 艾滋病患者的亲属
D. 流动人口、服务行业人员
E. 普通人群

正确答案：E。普通人群